现行《中小学校教室采光和照明卫生标准》规定，教室宜采用的光源色温为
A. 1100～2200K
B. 2200～3300K
C. 3300～4400K
D. 3300～5500K
E. 4400～5500K

正确答案：D。3300～5500K